测定大气中有害气体的采样高度为
A. 呼吸带高度
B. 0.5m高度
C. 1.0m高度
D. 3m高度
E. 5m高度

正确答案：A。呼吸带高度

解析：本题考查测定大气中有害气体的采样高度。人们在正常呼吸时，大气中的有害气体会直接进入人体，因此采样高度应该与人们呼吸的高度相同（A对BCDE错）。